形成腭中缝的是
A. 额突
B. 颧突
C. 腭突
D. 喙突
E. 上颌牙槽突

正确答案：C。腭突

解析：腭突与对侧腭突在中线相接，形成腭中缝，腭突的下面参与构成硬腭的前3/4。掌握“上颌骨解剖特点”知识点。